中药在人类防病治病中，具有不可替代的作用。中药使用的优势不包括
A. 资源优势
B. 疗效优势
C. 价格优势
D. 预防保健优势

正确答案：C。价格优势

解析：本题考查中药使用的优势。中药在人类防病治病中，具有不可替代的作用。中药使用的优势不包括价格优势（C错，为本题正确答案）。中药的资源优势（A对）、疗效优势（B对）、预防保健优势（D对）及市场前景越来越被国际社会认可，对促进世界医药科学的发展和人类健康产生积极影响。